某男，81岁。患消渴病20年，小便频数，甚则饮一溲一，咽干舌燥，面容憔悴，耳轮干枯，腰膝酸软，畏寒肢冷；舌白少津，脉沉细无力。根据辨证，宜选用的中成药是
A. 麦味地黄丸
B. 金匮肾气丸
C. 人参固本丸
D. 补中益气丸
E. 知柏地黄丸

正确答案：B。金匮肾气丸

解析：本题考查的是消渴的辨证论治。某男，81岁。患消渴病20年，小便频数，甚则饮一溲一，咽干舌燥，面容憔悴，耳轮干枯，腰膝酸软，畏寒肢冷；舌白少津，脉沉细无力。根据辨证，宜选用的中成药是金匮肾气丸（B对）。消渴阴阳两虚证：【症状】小便频数，甚则饮一溲一，咽干舌燥，面容憔悴，耳轮干枯，腰膝酸软，畏寒肢冷。舌淡，苔白少津，脉沉细无力。【中成药应用】常用中成药有金匮肾气丸。消渴肾阴亏虚证：【症状】尿频量多，浊如膏脂，腰酸膝软，头晕耳鸣，多梦遗精，乏力，皮肤干燥。舌红少苔，脉细数。【中成药应用】常用中成药有六味地黄丸（水蜜丸）、麦味地黄丸（水蜜丸）（A错）。虚劳阴虚证：【症状】形体消瘦，口燥咽干，潮热颧红，五心烦热，盗汗，小便短黄，大便干结。舌质红，舌面少津，苔少或无苔，脉细数。【中成药应用】常用中成药有人参固本丸（大蜜丸）（C错）、河车大造丸。泄泻脾胃虚弱证：【症状】大便时溏时泻，迁延反复，食少，食后脘闷不舒，稍进油腻食物，则大便次数增多，面色萎黄，神疲倦怠。舌质淡，苔白，脉细弱。【中成药应用】常用中成药有人参健脾丸（大蜜丸）、补中益气丸（水丸）（D错）、参苓健脾胃颗粒。阴虚发热证：【症状】午后潮热，或夜间发热，不欲近衣，手足心热，烦躁，少寐多梦，盗汗，口干咽燥。舌质红，或有裂纹，苔少甚至无苔，脉细数。【中成药应用】常用中成药有知柏地黄丸（E错）。